可使亲电子剂解毒的结合反应为
A. 葡萄糖醛酸结合
B. 谷胱甘肽结合
C. 硫酸结合
D. 乙酰化作用
E. 甲基化作用

正确答案：B。谷胱甘肽结合